以下关于桩冠的说法哪项是错误的
A. 桩越长固位越好
B. 固位力取决于摩擦力和粘接力
C. 桩冠修复后，增加根尖病的发生
D. 修复前必须行完善的根充
E. 可作固定桥的固位体

正确答案：C。桩冠修复后，增加根尖病的发生

解析：本题考查桩核冠。关于桩冠的说法错误的是桩冠修复后，增加根尖病的发生（C错，为本题的正确答案）。桩冠（桩核冠）固位力取决于桩核与管壁的摩擦力和粘接力（B对），桩越长（A对），则桩与管壁的接触面积就越大，摩擦力和粘接力就越大，产生的固位力就越大，固位就越好。桩冠修复前必须行完善的根管治疗（D对），保证根管恰填，根尖周病得到控制，在行桩冠预备的时候必须保证根尖封闭，保留不少于4mm的根充材料，桩冠修复的原因是单纯冠修复无法获得足够固位和抗力，目的是恢复缺损和功能，与减少根尖病的发生。没有关系若患牙牙冠缺损中度以上，剩余牙体组织无法提供足够固位，可行桩冠修复以后做为固定桥的固位体（E对），可以保留患牙，又能继续进行修复。